在体内因阻断hERG钾通道，可诱发室性心律失常而撤市的药物是
A. 阿司咪唑
B. 丙米嗪
C. 文拉法辛
D. 普拉洛尔
E. 尼卡地平

正确答案：A。阿司咪唑

解析：本题考查药物与体内代谢过程引发的毒副作用。阿司咪唑（A对）因干扰心肌细胞K⁺通道，引发致死性尖端扭转型室性心动过速，导致药源性心律失常，被美国FDA从市场撤回，并建议修改这类药物的说明书。